单纯行刮除术后易复发的颌骨囊肿是
A. 根端囊肿
B. 角化囊肿
C. 始基囊肿
D. 含牙囊肿
E. 血管外渗性囊肿

正确答案：B。角化囊肿

解析：角化囊肿容易复发（文献报道其复发率为3%～60%）；角化囊肿也可发生恶变，因此手术刮除要求更彻底；在刮除囊壁后用苯酚或硝酸银等腐蚀剂涂抹骨创，或加用冷冻疗法，以消灭子囊，防止复发。必要时还可考虑在囊肿外围切除部分骨质。掌握“牙源性颌骨囊肿”知识点。